对普通培养基的灭菌，宜采用
A. 煮沸法
B. 巴氏消毒法
C. 流通蒸气灭菌法
D. 高压蒸汽灭菌法
E. 间歇灭菌法

正确答案：D。高压蒸汽灭菌法

解析：高压蒸汽灭菌法：常用于培养基、葡萄糖盐水输液、敷料及各种耐高温耐湿物品的灭菌。掌握“消毒与灭菌”知识点。